鉴别上尿路结石与腹腔钙化灶常用的检查方法是
A. 静脉尿路造影
B. CT
C. 腹部侧位X线平片
D. B超
E. MRI

正确答案：C。腹部侧位X线平片

解析：腹部X线平片能发现90%以上的X线阳性结石，上尿路结石在腹部正位X线平片上易与腹腔钙化灶混淆，腹部侧位X线平片（C对）可将两者鉴别，在腹部侧位X线平片中，上尿路结石位于椎体前缘之后，腹腔内钙化阴影则位于椎体之前。静脉尿路造影（A错）诊断尿路结石需加行腹部X线片。CT（B错）对上尿路结石与腹腔钙化灶的显示效果要优于尿路平片，但价格昂贵，故不常用。B超（D错）、MRI（E错）对腹腔钙化灶的显示效果不佳，不能用于鉴别上尿路结石与腹腔钙化灶。